关于脂肪酸β-氧化的叙述，错误的是
A. 酶系存在于线粒体中
B. 不发生脱水反应
C. 需要FAD及NAD⁺为受氢体
D. 脂肪酸的活化是必要的步骤
E. 每进行一次β-氧化产生2分子乙酰CoA

正确答案：E。每进行一次β-氧化产生2分子乙酰CoA